刘某自行学医开设门诊，因违反诊疗护理常规致使患者死亡，追究其刑事责任的机关是
A. 管辖地人民政府
B. 工商行政部门
C. 管辖地人民法院
D. 卫生行政部门
E. 医疗事故鉴定委员会

正确答案：C。管辖地人民法院

解析：刘某自行学医开设门诊，因违反诊疗护理常规致使患者死亡，追究其刑事责任的机关是管辖地人民法院。一般地域管辖 对公民提起的民事诉讼，由被告住所地人民法院管辖；被告住所地与经常居住地不一致的，由经常居住地人民法院管辖（C对A错）。国家工商行政管理总局负责组织、指导、协调全国工商行政管理工作；省、自治区、直辖市工商行政管理局是同级人民政府的职能机构，负责组织、指导、协调本行政辖区内的工商行政管理工作，对同级人民政府负责并报告工作，其业务工作接受国家工商行政管理局监督与指导（B错）。实施卫生法中的行政处罚的卫生行政主管机关是县级以上的卫生行政管理部门（D错）。医疗事故技术鉴定由医疗事故技术鉴定委员会进行鉴定，该委员会是政府的下设机构，属于卫生行政部门管理（E错）。